患者，男，40岁。慢性肝炎史10余年，胁肋隐痛，悠悠不休，口燥咽干，手足心热，头晕耳鸣，舌红少苔，脉细弱。治疗应首选
A. 逍遥散
B. 龙胆泻肝汤
C. 茵陈蒿汤
D. 膈下逐瘀汤
E. 一贯煎

正确答案：E。一贯煎

解析：肝郁日久化热，耗伤肝阴，或久病体虚，精血亏损，不能濡养肝络，故胁肋隐痛，悠悠不休，阴虚易生内热，故口燥咽干，手足心热，精血亏损，不能上荣，故头晕目眩，故该患者为肝肾阴虚证，治法为滋养肝肾，化气利水，方药选用一贯煎合膈下逐瘀汤加减（E对）。逍遥散（A错）可疏肝解郁，补气健脾，用于治疗肝郁脾虚证；龙胆泻肝汤（B错）可以清泻肝胆实火，清利肝经湿热，治疗肝胆实火上炎证，肝经湿热下注证；茵陈蒿汤（C错）可清热去湿，利胆退黄，治疗湿热黄疸；膈下逐瘀汤（D错）可以活血祛瘀，行气止痛，用于治疗膈下血瘀证。